关于异位妊娠破裂的诊断下述哪项最重要
A. 病史
B. 腹部检查及阴道检查
C. 后穹隆穿刺
D. hCG测定
E. 诊刮

正确答案：C。后穹隆穿刺

解析：异位妊娠时，阴道后穹窿穿刺为简单、可靠的方法。阴道后穹窿穿刺适用于疑有腹腔内出血的患者，腹腔内出血最易积聚直肠子宫陷凹，即使血量不多，也能抽出血液，抽出暗红色不凝血提示有血腹症存在。陈旧性宫外孕时，可抽出小块或不凝固的陈旧血液。所以C最重要。掌握“异位妊娠”知识点。